《药品经营管理规范》对药品零售企业药品陈列的要求有
A. 药品与非药品分开存放
B. 内服药与外用药应分开存放
C. 处方药与非处方药应分柜摆放
D. 危险品应专柜陈列
E. 易串味的药品与一般药品应分开存放

正确答案：A、B、C、E。药品与非药品分开存放；内服药与外用药应分开存放；处方药与非处方药应分柜摆放；易串味的药品与一般药品应分开存放

解析：本题考查药品陈列要求。药品与非药品分开存放（A对）、内服药与外用药应分开存放（B对）、处方药与非处方药应分柜摆放（C对）、易串味的药品与一般药品应分开存放（E对）。